通过与物料接触的壁面传递热能，使物料中的湿分气化而达到干燥目的的方法是
A. 辐射干燥
B. 传导干燥
C. 介电加热干燥
D. 对流干燥
E. 间歇式干燥

正确答案：B。传导干燥

解析：本题考查传导干燥的原理。传导干燥（B对）：通过与物料接触的壁面传递热能，使物料中的湿分气化而达到干燥目的。